治疗癥瘕湿热瘀阻证,应首选的方剂是
A. 苍附导痰丸合桂枝茯苓丸
B. 补肾祛瘀方
C. 大黄䗪虫丸
D. 香棱丸
E. 大黄牡丹汤

正确答案：E。大黄牡丹汤

解析：癥瘕湿热瘀阻证，治法清热利湿，化瘀消癥，用大黄牡丹汤，功用：泻热破结，散结消肿，方中大黄清热解毒，祛瘀通便；丹皮凉血散瘀为君，芒硝助大黄清热解毒，泻下通便为臣；桃仁、丹皮活血化瘀为佐，冬瓜仁排脓散结为使。五味合用，共奏泻热逐瘀，散结消痈之功（E对）。癥瘕痰湿瘀结证用苍附导痰丸合桂枝茯苓丸（A错）。癥瘕肾虚血瘀证用补肾祛瘀方（B错）。癥瘕气滞血瘀证用大黄䗪虫丸（C错）。癥瘕气滞血瘀证用香棱丸（D错）。